下列有关龋病再矿化治疗的叙述中，不正确的是
A. 是消除早期龋损的一种治疗方法
B. 可用于光滑面早期釉质龋
C. 龋易感者的龋病预防
D. 再矿化液的pH一般调至5
E. 再矿化液主要含有不同比例的钙、磷和氟

正确答案：D。再矿化液的pH一般调至5

解析：再矿化液主要含有不同比例的钙、磷和氟。加入氟可明显促进釉质再矿化。再矿化液的pH一般调至7。酸性环境可减弱矿化液的再矿化作用。掌握“龋病的治疗原则与非手术治疗方法”知识点。